激活的PKC能磷酸化的氨基酸残基是
A. 酪氨酸/丝氨酸
B. 酪氨酸/苏氨酸
C. 丝氨酸/苏氨酸
D. 丝氨酸/组氨酸
E. 苏氨酸/组氨酸

正确答案：C。丝氨酸/苏氨酸